七情刺激中易导致心气涣散的是
A. 喜
B. 怒
C. 悲
D. 恐
E. 惊

正确答案：A。喜

解析：如《素问·举痛论》说：“百病生于气也，怒则气上（B错），喜则气缓，悲则气消（C错），恐则气下（D错），惊则气乱（E错），思则气结”。其中喜则气缓是指过度喜乐伤心，导致心气涣散不收（A对），重者心气暴脱或神不守舍的病机变化。临床可见精神不能集中，甚则神志失常，狂乱，或见心气暴脱的大汗淋漓、气息微弱、脉微欲绝等症。